手机消毒不能采用下述哪种方法
A. 甲醛蒸汽熏
B. 高压消毒
C. 紫外线消毒
D. 2％碘酊擦拭后再用75％酒精擦拭
E. 0.1％新洁尔灭液浸泡

正确答案：E。0.1％新洁尔灭液浸泡

解析：本题考查手机消毒的方法。新洁尔灭液常用于外科手术前洗手，皮肤黏膜消毒，对于手机用0.1％新洁尔灭液浸泡（E错，为本题的正确答案）会使手机生锈，不利于手机的保养维护。手机内部轴承管道结构精细，内表面无法进入清洁，对手机的消毒可采用甲醛蒸汽熏（A对），高压消毒（B对）、紫外线消毒（C对）、2％碘酊擦拭后再用75％酒精擦拭（D对）手机表面等措施来进行。